成熟红细胞利用葡萄糖的主要代谢途径是
A. 磷酸戊糖途径
B. 无氧酵解
C. 有氧氧化
D. 三羧酸循环
E. 糖原分解

正确答案：B。无氧酵解